主要含有黄酮醇苷和萜类内酯成分的中药是
A. 紫草
B. 银杏叶
C. 葛根
D. 满山红
E. 陈皮

正确答案：B。银杏叶

解析：本题考查的是含黄酮类的常用中药。主要含有黄酮醇苷和萜类内酯成分的中药是银杏叶（B对）。银杏叶中的黄酮类化合物有黄酮、黄酮醇及其苷类、双黄酮和儿茶素类等。《中国药典》以总黄酮醇苷和萜类内酯为指标成分进行含量测定。要求总黄酮醇苷不少于0.4%，对照品采用槲皮素、山柰素和异鼠李素；要求萜类内酯不少于0.25%，对照品采用银杏内酯A、银杏内酯B、银杏内酯C和白果内酯。紫草（A错）的主要化学成分为萘醌类化合物，包括乙酰紫草素、欧紫草素、紫草素、β,β'-二甲基丙烯酰紫草素、β,β'-二甲基丙烯酰欧紫草素、去氧紫根素等。《中国药典》采用紫外分光光度法测定药材中羟基萘醌总含量，以左旋紫草素计，不得少于0.80%，采用高效液相色谱法测定药材中β,β'-二甲基丙烯酰阿卡宁（β,β'-二甲基丙烯酰欧紫草素）的含量，不得少于0.30%。葛根（C错）含异黄酮类化合物，主要成分有大豆素、大豆苷、大豆素-7,4'-二葡萄糖苷及葛根素、葛根素-7-木糖苷。《中国药典》以葛根素为指标成分进行含量测定，要求含葛根素不得少于2.4%。满山红（D错）叶中含有杜鹃素、8-去甲基杜鹃素、山柰酚、槲皮素、杨梅素、金丝桃苷、异金丝桃苷以及莨菪亭、伞形酮、木毒素、牻牛儿酮、薄荷醇、杜松脑和α-桉叶醇、β-桉叶醇、γ-桉叶醇等。其中杜鹃素为祛痰成分，临床用于治疗慢性支气管炎。《中国药典》以杜鹃素为对照品对满山红进行含量测定。要求杜鹃素含量不少于0.08%。陈皮（E错）中除含挥发油外，还含有多种黄酮类化合物，其中橙皮苷多制成甲基橙皮苷供药用，是治疗冠心病药物“脉通”的重要原料之一。《中国药典》以橙皮苷为指标成分对陈皮进行含量测定。要求陈皮中橙皮苷含量不得少于3.5%；广陈皮中橙皮苷含量不得少于2.0%，对广陈皮，另外要求测定川陈皮素和橘皮素的总量，总量不得少于0.42%。